为防止婴儿患佝偻病，维生素D每日预防量应是
A. 400IU
B. 1000IU
C. 1600IU
D. 2000IU
E. 2500IU

正确答案：A。400IU

解析：本题考查维生素D缺乏性佝偻病的预防措施。维生素D缺乏性佝偻病是婴幼儿期常见的营养缺乏症，婴幼儿期生长发育旺盛，骨骼的生长发育迅速，维生素D不足致使钙、磷代谢失常，正在生长的骨骺端软骨板不能正常钙化造成骨骼病变。一般维生素D每日预防量为400IU（A对BCDE错），直至2～3岁。